有关SO₂的说法中，错误的是
A. 主要作用部位是上呼吸道
B. 与可吸入颗粒物共存，其毒性大大增强
C. 可以增强BaP的致癌作用
D. 哮喘患者对SO₂更为敏感
E. 主要来源于硫酸厂

正确答案：E。主要来源于硫酸厂

解析：本题考查SO₂的相关内容。一切含硫燃料的燃烧都能产生SO₂。大气中的SO₂主要来自固定污染源，其中约70%来自火力发电厂等的燃煤污染（E错，为本题正确答案），约26%来自有色金属冶炼﹑钢铁、化工、炼油和硫酸厂等生产过程，其他来源仅占4%左右。SO₂的主要作用部位是上呼吸道（A对），与可吸入颗粒物共存，其毒性大大增强（B对）。吸附SO₂的颗粒物是变态反应原，能引起支气管哮喘（D对）。SO₂还有促癌作用，可增强BaP的致癌作用（C对）。